前腭杆后缘和后腭杆前缘不少于
A. 6mm
B. 4～6mm
C. 15mm
D. 16mm
E. 17mm

正确答案：C。15mm

解析：本题考查大连接体的类型与要求。前腭杆后缘和后腭杆前缘不少于15mm（C对）。当联合使用前、后、侧腭杆作为大连接体时，称为前-后杆联合连接体，前腭杆后缘和后腭杆前缘间的距离应不少于15mm。